与侵袭力有关的物质主要是
A. 黏附素
B. 荚膜
C. 侵袭素
D. 侵袭性酶
E. 以上均正确

正确答案：E。以上均正确

解析：细菌的侵袭力包括与黏附、定植和产生侵袭性相关物质的能力，与侵袭力有关的物质主要由黏附素、荚膜、侵袭素、侵袭性酶类和细菌生物被膜等。掌握“医院感染及细菌的致病性”知识点。